治疗多发性硬化症
A. 抗CD3单克隆抗体
B. 抗肿瘤坏死因子抗体
C. β干扰素
D. α干扰素
E. EPO

正确答案：C。β干扰素

解析：多发性硬化症为终身性疾病，其缓解期治疗以控制疾病进展为主要目标，推荐使用DMT，包括免疫治疗和免疫抑制治疗。β干扰素为其一线药物（C对）。（多发性硬化诊断和治疗中国专家共识（2011版））。抗CD3单克隆抗体，为免疫抑制剂，产生免疫抑制作用和抗排斥作用（A错）。抗肿瘤坏死因子抗体主要用于治疗类风湿关节炎（B错）。α干扰素具有抗病毒、抗肿瘤和免疫调节作用，常用于急、慢性肝炎的治疗（D错）。EPO能够促进红细胞生成，用于治疗贫血，尤其是肾性贫血（E错）。